急性浆液性根尖周炎的主要主诉症状是
A. 早期患牙不适，有发木感
B. 患牙有伸长发胀感
C. 自发性、持续性钝痛
D. 患牙咬合痛
E. 有松动感

正确答案：D。患牙咬合痛

解析：本题考查急性浆液性根尖周炎的主要主诉症状。急性浆液性根尖周炎的主要主诉症状是患牙咬合痛（D对）,这是因为根尖周膜充血水肿而表现出来的症状。早期患牙不适，有发木感（A错）、患牙有伸长发胀感（B错）、自发性、持续性钝痛（C错）、有松动感（E错）等症状随着病变的进行性发展都会出现，但是患牙咬合痛仍是最典型症状。